结构与葡萄糖类似，对α-葡萄糖苷酶有强效抑制作用的降血糖药物是
A. 格列美脲
B. 米格列奈
C. 盐酸二甲双胍
D. 吡格列酮
E. 米格列醇

正确答案：E。米格列醇

解析：本题考查米格列醇。米格列醇（E对）结构与葡萄糖类似，是α-葡萄糖苷酶抑制剂，可降低餐后血糖。格列美脲（A错）为磺酰脲类降血糖药，其选择性作用于胰腺β细胞，促进胰岛素的释放。米格列奈（B错）为非磺酰脲类降糖药，作用机制与格列美脲相同。盐酸二甲双胍和吡格列酮均是胰岛素增敏剂，可提高受体对胰岛素的敏感性，其中盐酸二甲双胍（C错）为二甲双胍结构，吡格列酮（D错）为噻唑烷二酮结构。